颈部最大的浅静脉是
A. 颈内静脉
B. 面静脉
C. 颈外静脉
D. 下颌后静脉
E. 耳后静脉

正确答案：C。颈外静脉

解析：颈外静脉和颈前静脉为颈部浅静脉，其中颈外静脉（C对）为颈部最大的浅静脉。